下列组合中，属于联合化疗的是
A. CHOP方案（环磷酰胺+阿霉素+长春新碱+泼尼松）
B. MTX方案（甲氨蝶呤小剂量鞘内注射+甲氨蝶呤大剂量静脉输注）
C. CTX+美司钠（环磷酰胺+美司钠）
D. VEGF抑制剂+ALK抑制剂（贝伐珠单抗+奧希替尼）
E. EGFR抑制剂+PD-L1抑制剂（曲妥珠单抗+帕博利珠单抗）

正确答案：A。CHOP方案（环磷酰胺+阿霉素+长春新碱+泼尼松）

解析：本题考查联合化疗方案。属于联合化疗的是CHOP方案（环磷酰胺+阿霉素+长春新碱+泼尼松）（A对）。MTX方案（甲氨蝶呤小剂量鞘内注射+甲氨蝶呤大剂量静脉输注）（B错）用于类风湿性关节炎。VEGF抑制剂+ALK抑制剂（贝伐珠单抗+奧希替尼）（C错）用于转移性EGFR突变肺癌患者的治疗。